女性，20岁。四肢皮肤反复出现紫斑1年。检查：肝脾不大，轻度贫血，血小板60×10⁹/L，骨髓颗粒型巨核细胞比例增加。其诊断为
A. 急性白血病
B. 再生障碍性贫血
C. 脾功能亢进
D. 过敏性紫癜
E. 特发性血小板减少性紫癜

正确答案：E。特发性血小板减少性紫癜

解析：患者青年女性，四肢皮肤反复出现紫斑1年（考虑紫癜性疾病），查体肝脾不大，有轻度贫血（由失血过多导致），血小板60×109/L（正常值（100~300）×10⁹/L，提示血小板计数减少），骨髓颗粒型巨核细胞比例增加（提示巨核细胞发育成熟障碍），综合该患者的病史、体查、实验室检查，其诊断为特发性血小板减少性紫癜（E对）。急性白血病（P580）（A错）主要表现为贫血、发热、出血，常有肝脏轻中度肿大、胸骨下端局部压痛，白细胞往往显著增加，骨髓象见原始细胞增多。再生障碍性贫血（P558）（B错）的血象表现为全血细胞减少，骨髓象表现为骨髓增生低下，可见骨髓小粒空虚。脾功能亢进（P612）（C错）时患者有脾大表现。过敏性紫癜（P623）（D错）的患者血小板计数正常，骨髓象检查均正常。